老年女性，心功能衰竭，服用呋塞米及螺内酯片，正确的使用方法是
A. 清晨服用
B. 用温水调服
C. 应同时碱化尿液
D. 舌下含服
E. 睡前服用

正确答案：A。清晨服用

解析：本题考查药品服用的适宜时间。呋塞米、螺内酯为利尿药，宜于清晨服用（A对），避免夜间排尿次数过多。宜睡前服用（E错）的药物有催眠药、平喘药、调节血脂药、抗过敏药、钙剂。含活性菌类药物遇热会引起活性菌被破坏，不能用热水送服（B错）。硝酸甘油片，舌下含服（D错），用于稳定型心绞痛。苯溴马隆服用时应多饮水，同时应碱化尿液（C错），防止形成尿酸结石。